下列H₂受体拮抗剂中，具有抗雄激素作用，大量长期应用可产生内分泌紊乱的药物是
A. 西咪替丁
B. 雷尼替丁
C. 法莫替丁
D. 罗沙替丁
E. 尼扎替丁

正确答案：D。罗沙替丁